某体育老师欲根据同学的健康状况将他们分为基本组、准备组和特别组。对于特别组的同学，老师将按特定的教学大纲进行体育教学。以下同学不应该被分在特别组中的是
A. 患心肌炎后刚刚康复
B. 器质性心脏病，以前很少运动
C. 曾患小儿麻痹症，现留有后遗症
D. 血压增高，心肾检查有病理改变，心血管功能仍属正常
E. 浸润性肺结核，最近食欲、睡眠不佳，体温持续低热，有盗汗症状

正确答案：D。血压增高，心肾检查有病理改变，心血管功能仍属正常